属于Ⅱ型超敏反应的疾病是
A. 支气管哮喘
B. 血清病
C. 药物过敏性休克
D. 接触性皮炎
E. 自身免疫性溶血性贫血

正确答案：E。自身免疫性溶血性贫血

解析：Ⅱ型超敏反应又称为细胞型或细胞毒型超敏反应，是由IgG或IgM抗体与靶细胞表面相应抗原结合后，在补体、吞噬细胞和NK细胞参与下，引起的以细胞溶解或组织损伤为主的病理免疫反应。与Ⅱ型超敏反应有关的疾病有输血反应、新生儿溶血病、自身免疫溶血性贫血（E对）、药物过敏性血细胞减少症等。支气管哮喘（A错）、药物过敏性休克（C错）属于Ⅰ型超敏反应（P148）。血清病（B错）属于Ⅲ型超敏反应（P152）。接触性皮炎（D错）（P154）为典型的Ⅳ型超敏反应。